患者，男，60岁，诊断为房性心律失常，医生给予胺碘酮治疗。近日，因胃溃疡开始用西咪替丁，出现窦性心动过缓症状。胺碘酮典型不良反应：（①光敏反应，治疗期间避免暴露于阳光下；②肺纤维化；③血糖升高；④甲状腺功能减退；⑤甲状腺功能亢进）。
A. ①②④⑤
B. ①③⑤
C. ②④⑤
D. ③④⑤
E. ①②③④

正确答案：A。①②④⑤

解析：本题考查胺碘酮的不良反应。胺碘酮典型不良反应：①光敏反应，治疗期间避免暴露于阳光下②肺纤维化④甲状腺功能减退⑤甲状腺功能亢进（A对）。胺碘酮可引起肺毒性（发生率15%～20%），最早表现为咳嗽，但病情发展时可出现发热和呼吸困难，表现为急性肺炎（2%～5%），长期治疗发生率会更高。胺碘酮诱发急性肺炎后所致的成人呼吸窘迫综合征多见于术后即刻。该药还可引起的慢性肺间质纤维化。另外，甲状腺功能减退（1%～22%）较为常见、发生比较隐匿；另可致甲状腺功能亢进（﹤3%）， 加重心房颤动或出现快速室性心律失常，故应停用胺碘酮。服药者常发生显著的光过敏（20%）。